患者，女，2米高处跌落后2小时，右腰部着地，伤后腰痛且全程可见肉眼血尿，P90次/分，BP110/70mmHg，右腰部青紫压痛，腹部无压痛反跳痛。最可能损伤部位
A. 输尿管
B. 肾
C. 脾
D. 膀胱
E. 尿道

正确答案：B。肾

解析：患者女，高处跌落、右腰部着地（直接暴力（撞击）），腰痛、全程肉眼血尿（肾外伤临床表现）右腰部青紫压痛（出血或尿外渗），结合病史、临床表现，考虑肾损伤（B对）。输尿管位于腹膜后间隙，周围组织对其有良好的保护，输尿管外伤（A错）多为医源性外伤，外界暴力所致少见。患者血压正常，无腹膜刺激征，不是脾损伤（C错）。膀胱外伤（D错）：膀胱壁轻度挫伤仅有下腹部疼痛和少量终末血尿，膀胱破裂后尿液流入腹腔和膀胱周围时，有尿意，但不能排出尿液或仅排出少量血尿。尿道外伤（E错）：前尿道外伤后即有鲜血自尿道外口滴出或溢出，后尿道外伤尿道外口无流血或仅有少量血液流出。